用人单位
A. 发现疑似职业病患者时，应当告知劳动者本人并及时通知用人单位
B. 承担疑似职业病患者在诊断，医学观察期间的费用
C. 客观、公正地进行诊断鉴定
D. 签署职业病诊断证明书
E. 依法享受国家规定的职业病待遇

正确答案：B。承担疑似职业病患者在诊断，医学观察期间的费用